血中总胆红素量多少时，临床出现黄疸
A. ﹤3.4μmol/L
B. 3.4～17.1μmol/L
C. 17.1～34.2μmol/L
D. ﹥34.2μmol/L
E. 3.4～6.8μmol/L

正确答案：D。﹥34.2μmol/L